干槽症症状通常发生在拔牙术后
A. 术后1小时
B. 术后第1天
C. 术后2～3天
D. 术后5～6天
E. 术后1周

正确答案：C。术后2～3天

解析：本题考查干槽症。干槽症症状通常发生在拔牙术后2～3天（C对）出现，表现为剧烈疼痛，并可向耳颞部、下颌区或头颈部放射，拔牙窝内可空虚，或有腐败变性的血凝块，腐臭味强烈。正常情况下，拔牙术后15～30min血凝块形成；术后第一天（B错）有来自牙槽骨壁的成纤维细胞向血块内生长，同时有来自临近血管的内皮细胞增殖，形成血管芽，开始形成肉芽组织；3～4天后结缔组织开始替代肉芽组织；术后5～8天开始形成新骨；3～6个月拔牙窝完全愈合。